脂溶性维生素的主要排泄途径是
A. 乳汁排泄
B. 唾液排泄
C. 汗液排泄
D. 胆汁排泄
E. 尿液排泄

正确答案：D。胆汁排泄

解析：本题考查药物排泄途径。脂溶性维生素如维生素A的主要消除路径是通过胆汁排泄（D对）。